不属于氯己定的副作用表现的是
A. 树脂类修复体龈1/3处易染成棕黄色
B. 可使牙、舌背上发生染色
C. 染色沉积在牙表面
D. 对口腔黏膜有轻度的刺激作用
E. 染色不能通过打磨、刷牙方法去除

正确答案：E。染色不能通过打磨、刷牙方法去除

解析：氯己定的副作用表现在：①使牙、修复体或舌背上发生染色，特别是树脂类修复体的周围和牙面龈1/3处，易染成棕黄色；染色沉积在牙表面，不透入牙内，可通过打磨、刷牙或其他机械方法去除；②氯己定味苦，必须在其中加入调味剂；③对口腔黏膜有轻度的刺激作用。掌握“菌斑控制及提高宿主抵抗力”知识点。